甲氨蝶呤合用复方磺胺甲噁唑，产生的相互作用可能导致
A. 降压作用增强
B. 巨幼红细胞症
C. 抗凝作用下降
D. 高血钾症
E. 肾毒性增强

正确答案：B。巨幼红细胞症

解析：本题考查药物的相互作用。甲氨蝶呤合用复方磺胺甲噁唑，产生的相互作用可能导致巨幼红细胞症（B对）；降压药与引起低血压的药物合用可增加降压作用（A错）；华法林与维生素K合用会使抗凝作用下降（C错）；补钾剂与保钾利尿药合用可能引起高血钾症（D错）；肾毒性药与庆大霉素等合用可能导致肾毒性增加（E错）。